重度营养不良患儿调整饮食，每日开始供给的热量应是
A. 30 kcal/Kg
B. 40 kcal/Kg
C. 50 kcal/Kg
D. 60 kcal/Kg
E. 70 kcal/Kg

正确答案：B。40 kcal/Kg

解析：本例为重度营养不良，机体已经适应低能量饮食，患儿调整饮食情况，应从每日40～55kcal/kg开始（B对），逐步少量增加。